下述哪种酶缺乏可致白化病
A. 酪氨酸转氨酶
B. 苯丙氨酸转氨酶
C. 苯丙酮酸羟化酶
D. 酪氨酸羟化酶
E. 酪氨酸酶

正确答案：E。酪氨酸酶